颌骨炎症，有口内或口外瘘管形成时称
A. 慢性颌骨骨髓炎
B. 放射性颌骨骨髓炎
C. 新生儿颌骨骨髓炎
D. 化学性颌骨骨髓炎
E. 化脓性颌骨骨髓炎

正确答案：A。慢性颌骨骨髓炎

解析：慢性中央性颌骨骨髓炎的主要诊断依据是瘘管形成和溢脓；死骨形成后，可从瘘孔排出死骨片；瘘管用探针检查可触知骨面粗糙。掌握“颌骨骨髓炎”知识点。